对于一种危害严重的疾病，采取针对病因的措施后，在评价其预防效果时应采用那些指标最合适
A. 死亡率
B. 发病率
C. 患病率
D. 病死率
E. 罹患率

正确答案：B。发病率

解析：本题考查发病率的应用。发病率（B对ACDE错）是疾病流行强度的指标，反映疾病对人群健康影响的程度，发病率高对人群健康危害大。通过发病率的比较，可了解疾病流行特征，探讨病因因素，提出病因假说，评价防制措施的效果。